不宜行组织活检术的肿瘤为
A. 舌癌
B. 骨肉瘤
C. 黏液瘤
D. 颈动脉体瘤
E. 恶性淋巴瘤

正确答案：D。颈动脉体瘤

解析：本题考查不宜行组织活检术的肿瘤。组织活检是指在病变部位取一小块组织制成切片，在显微镜下观察细胞组织的形态与结构，以确定病变的性质、类型和分化程度等。颈动脉体瘤（D对）属于血管性瘤样病变，不是真性肿瘤，组织活检可造成大出血，故不宜行组织活检。舌癌（A错）、骨肉瘤（B错）、黏液瘤（C错）、恶性淋巴瘤（E错）均属于真性肿瘤，组织活检一般不会引起重的并发症，均可行组织活检。